哮喘病在缓解期应调补的脏腑是
A. 心肝肾
B. 肺脾肾
C. 肝脾肾
D. 肺脾胃
E. 肺肝肾

正确答案：B。肺脾肾

解析：哮喘病属于肺系疾病，自然应当调补肺，若长期反复发作，寒痰伤及脾肾之阳，痰热耗灼肺肾之阴，则可由实转虚，平时表现肺、脾、肾等脏气虚弱之候（B对）。中医哮喘中的心与肺的关系不能与西医的肺心病混淆（A错）。哮喘病与中医的胃和肝关系不大（CDE错）。